心输出量是
A. 心脏每搏动一次所泵出的血量
B. 左右心室输出的总血液量
C. 每分钟左心室所泵出的血量
D. 心房进入心室的血量
E. 每分钟两心房进入心室的血量

正确答案：C。每分钟左心室所泵出的血量

解析：心输出量是一侧心室（B错）每分钟射出的血液量（C对），等于心率与搏出量的乘积，也称每分输出量，左右两心室的输出量基本相等。心脏每搏动一次所泵出的血量（A错），称为每搏输出量。